有关类固醇激素作用方式的叙述，正确的是
A. 激素可进入核内，直接促进转录
B. 激素与受体结合后激活G蛋白
C. 激素-受体复合物激活热休克蛋白
D. 激素与受体结合后促进受体解聚
E. 其受体具有转录因子功能

正确答案：E。其受体具有转录因子功能